以上辅料中，属于缓（控）释剂溶蚀骨架材料的是
A. 乙基纤维素
B. 蜂蜡
C. 微晶纤维素
D. 羟丙甲纤维素
E. 硬酯酸镁

正确答案：B。蜂蜡

解析：本题考查骨架型缓释材料。溶蚀性骨架材料是指疏水性强的脂肪类或蜡类物质，如动物脂肪、蜂蜡（B对）、巴西棕榈蜡、氢化植物油、硬脂醇、单硬脂酸甘油酯、硬脂酸丁酯等。乙基纤维素（A错）为不溶性骨架材料。微晶纤维素（C错）为片剂常用的稀释剂，不属于缓、控释制剂载体材料的范畴。羟丙甲纤维素（D错）为亲水凝胶骨架材料。硬酯酸镁（E错）为片剂常用的润滑剂，不属于缓、控释制剂载体材料的范畴。